在水液代谢呼吸运动及阴阳互资等方面密切相关的两脏是
A. 心与脾
B. 脾与肾
C. 肾与肝
D. 肝与肺
E. 肺与肾

正确答案：E。肺与肾

解析：肺与肾的关系，主要表现在呼吸运动、津液代谢及阴阳互资三个方面（E对）：①呼吸运动：肺司呼吸，肾主纳气。肺气肃降，吸入清气，下纳于肾；肾纳清气，以维持呼吸深度。故称“肺为气之主，肾为气之根”。②津液代谢：肺为水之上源，通调水道，宣发津液外出腠理为汗，肃降水液下行至肾。肾为主水之脏，升清降浊，清者上达于肺，浊者下输膀胱。肺肾两脏，相辅相成，共同完成津液的输布与排泄。③阴阳互资：肺与肾母子相生，阴液互资，称为“金水相生”，肺金为肾水之母，肺阴充足，下输于肾，使肾阴充盈；水能润金，肾阴为一身阴液的根本，肺阴依赖肾阴滋养而充盛。心与脾的关系，主要表现在血液生成与运行方面的相互为用、相互协同（A错）。脾与肾的关系，主要表现在先天后天相互资生与津液代谢方面（B错）。肾与肝之间的关系可称为“肝肾同源”即“乙癸同源”，包括精血同源、藏泄互用以及阴阳互滋互制等方面（C错）。肝与肺的关系，主要体现在调节人体气机升降方面（D错）。